一项病例对照研究，500名病例中有暴露史者400例，而500名对照中有暴露史者100例，其OR值为
A. 1.25
B. 1.6
C. 16
D. 160
E. 无法计算

正确答案：C。16

解析：本题考查比值比的计算。比值比的计算公式为ad/bc，根据题意可知，a＝400，d＝400，b＝100，c＝100，代入公式可知，OR＝400×400/（100×100）＝16（C对ABDE错）。